骶丛由下列哪些脊神经的前支组成
A. 腰骶干、S2~5、CO
B. Sl~5、CO
C. L5、Sl~5、CO
D. 腰骶干、Sl~5、CO
E. 无

正确答案：D。腰骶干、Sl~5、CO

解析：骶丛由来自腰丛的腰骶干、Sl~5、CO（D对）组成。腰骶干由第4腰神经前支的部分纤维和第5腰神经前支的所有纤维在腰丛下方合成。